三阴三阳经中，行于头部两侧的经脉是
A. 太阳经
B. 阳明经
C. 少阳经
D. 厥阴经
E. 少阴经

正确答案：C。少阳经

解析：诸阳经在头面部的分布特点是：少阳经（C对）行于头部两侧；太阳经（A错）行于头后枕部；阳明经（B错）行于前额部；厥阴经（D错）行于巅顶；少阴经（D错）不走行于头部。